一经产妇38岁，妊娠39周，在家中请接生婆接生，胎儿娩出后，有新鲜血流出，胎盘出完整，产妇产后一个小时阴道大出血估计有两大碗，接生婆认为子宫收缩好，产妇一般状态好，呼吸平稳，又观察2个小时，阴道出血不见减少，而后转诊到县医院，检查产妇血压为零，脉搏不清，阴道左侧壁裂伤至穹隆顶端，宫颈裂伤有4cm以上，经抢救无效死亡。该产妇曾孕4产2，引产1次，既往健康，本次妊娠未接受产前检查，认为曾经顺利分娩两次，在家分娩不会有问题。请问影响孕产妇死亡的主要因素是
A. 交通因素
B. 经济因素
C. 医疗保健机构因素
D. 个人孕产史因素
E. 家庭个人知识与态度因素

正确答案：E。家庭个人知识与态度因素

解析：本题考查影响孕产妇死亡的主要因素。该产妇对孕产期保健重要性认识不够，对接受医疗保健服务的态度存在问题，未接受产前保健，认为曾经顺利分娩两次，在家分娩不会有问题，请接生婆在家中分娩。由于接生婆的助产技术问题，没有识别异常、诊断、处理及判断转诊时机的能力，导致产妇大出血，失去抢救时机死亡，即影响孕产妇死亡的主要因素是家庭个人知识与态度因素（E对ABCD错）。